前壁心肌梗死并发短阵室速
A. 地尔硫䓬（硫氮革酮）
B. 洋地黄
C. 阿托品
D. 利多卡因
E. 胺碘酮

正确答案：D。利多卡因

解析：本题考查前壁心肌梗死并发短阵室速的药物治疗。前壁心肌梗死并发短阵室速选用利多卡因（D对）。地尔硫䓬（硫氮革酮）（A错）为非二氢吡啶类钙离子拮抗剂的代表药物，对心血管的作用介于苯烷胺类及二氢吡啶类之间，具有轻度的周围血管扩张作用并能增加冠脉及肾血流，已广泛用于缺血性心脏病及高血压的治疗。洋地黄（B错）可用于治疗心房纤颤、心房扑动、阵发性室上性心动过速，但在心肌缺氧、心肌病里损害时易发生不良反应。阿托品（C错）可用于治疗迷走神经过度兴奋所致的窦性心动过缓、窦房阻滞、房室传导阻滞等缓慢型心律失常；在急性心肌梗死的早期，尤其是发生在下壁或后壁的急性心肌梗死，常有窦性心动过缓，严重时可因低血压及迷走神经张力过高，导致房室传导阻滞，阿托品可恢复心率以维持合适的血流动力学，从而改善患者的临床症状。胺碘酮（E错）是广谱抗心律失常药，对心房扑动、心房颤动、室上性心动过速和室性心动过速有效。